三角肌
A. 属上肢带肌
B. 位于臂部
C. 起自锁骨
D. 止于肱骨大结节
E. 使肩关节内收

正确答案：A。属上肢带肌

解析：三角肌属上肢带肌（A对）；位于肩部，而非臂部（B错）；起自锁骨、肩峰和肩胛冈，而非锁骨（C错）；止于肱骨三角肌粗隆，而非肱骨大结节（D错）；使肩关节外展，而非内收（E错）。